患者，男，53岁，季节性过敏性鼻炎病史5年，3天前，受凉后出现流涕、鼻塞、咳嗽，咳痰，低热，头痛，无胸闷、气短等其他不适，已在医院发热门诊完成了鼻拭子检查，排除了甲型流感和乙型流感，诊断为普通感冒。患者在花粉季过敏性鼻炎发作，给予鼻用糖皮质激素治疗后，鼻塞症状未缓解，可联合应用的药品是
A. 泼尼松片
B. 氯苯那敏片
C. 色甘酸钠滴鼻剂
D. 氯雷他定片
E. 孟鲁司特钠片

正确答案：E。孟鲁司特钠片

解析：本题考查孟鲁司特。使用鼻用糖皮质激素治疗后，鼻塞症状未缓解，可联合应用的药品是孟鲁司特钠片（E对）。孟鲁司特为白三烯受体阻断剂，由于糖皮质激素不能完全有效地抑制半胱氨酰白三烯的合成及后续的炎性反应过程，因此对鼻用糖皮质激素治疗后鼻部症状（主要是鼻塞）未得到良好控制的中至重度过敏性鼻炎患者，可考虑联合应用白三烯受体阻断剂。泼尼松片（A错）为口服糖皮质激素，中至重度持续性过敏性鼻炎患者如通过其他治疗方法无法控制严重鼻塞症状时，可考虑短期口服糖皮质激素。氯苯那敏片（B错）为抗组胺类药，起效快速，作用持续时间较长，能明显缓解鼻部症状（特别是鼻痒、打喷嚏和流鼻涕），对合并眼部症状也有效，但对改善鼻塞的效果有限。对花粉过敏的患者，推荐在致敏花粉播散前进行预防性治疗，有利于症状控制，并根据花粉播散时间以及对症状产生的效果而决定疗程。色甘酸钠滴鼻剂（C错）为肥大细胞膜稳定剂，用于预防支气管哮喘和过敏性鼻炎。氯雷他定片（D错）为选择性外周H₁受体阻断药，可有效缓解鼻痒、喷嚏和流涕等症状，主要用于各种过敏性鼻炎、慢性荨麻疹及其他变态反应性疾病。